华法林是临床常用的口服抗凝药物。关于华法林合理使用的说法正确的有
A. 华法林对凝血因子充分抑制需要数天时间，因此起效缓慢
B. 华法林和肝素类似。体外也有抗凝活性
C. 为了加快华法林的起效，临床一般通过增加初始给药剂量的方法，加速已合成的凝血因子Ⅰ的清除
D. 华法林的抗凝作用能被维生素K₁所拮抗，因此在用药期间不应进食富含维生素K₁的绿色果蔬，如菠菜等
E. 华法林应用过量易致出血，对于严重的出血可以使用维生素K₁、新鲜血浆或凝血酶原复合物对抗治疗

正确答案：A、E。华法林对凝血因子充分抑制需要数天时间，因此起效缓慢；华法林应用过量易致出血，对于严重的出血可以使用维生素K₁、新鲜血浆或凝血酶原复合物对抗治疗

解析：本题考查华法林。华法林需要连续用药2～7日才能清除凝血因子，达到最大药效（A对）。华法林应用过量易致出血，如有高危出血倾向，可给予维生素K₁口服1～2.5mg。当有严重出血或INR>20时，可应用维生素K₁ 10mg、新鲜血浆和凝血酶原复合物缓慢静注（E对）。但高剂量维生素K₁能引起华法林抵抗，重新使用华法林时应同时给予肝素，直至患者恢复对华法林敏感性。